什么时期居住在高氟区可患氟牙症
A. 7岁之前
B. 7～12岁
C. 12～15岁
D. 15岁之后
E. 任何年龄

正确答案：A。7岁之前

解析：氟牙症的发生取决于过多氟进入人体的时机。氟主要损害釉质发育期牙胚的成釉细胞，因此，过多的氟只有在牙齿发育矿化期进入机体，才能导致氟牙症发生。若6、7岁之前，长期居住在饮水中氟含量高的流行区，即使日后迁往他处，也不能避免以后萌出的恒牙受累；反之，如7岁后才迁入高氟区者，则不出现氟牙症。掌握“氟牙症”知识点。